对机体各脏腑组织起推动、温煦作用的是
A. 肾精
B. 肾气
C. 肾阳
D. 天癸
E. 肾阴

正确答案：C。肾阳

解析：肾阳为一身阳气之本，“五脏之阳气，非此不能发”，能推动和激发脏腑的各种机能，能温煦全身脏腑形体官窍。肾阳充盛，脏腑形体官窍得以温煦，各种机能旺盛，精神振奋（C对）。肾精（A错）、肾气（B错）能促进机体生长发育与生殖机能成熟。天癸（D错）是肾精及肾气充盈到一定程度而产生的，是具有促进人体生殖器官发育成熟和维持人体生殖机能作用的一种精微物质。肾阴（E错）为一身阴气之本，“五脏之阴气，非此不能滋”，能宁静和抑制脏腑的各种机能，凉润全身脏腑形体官窍。